测结果为抗-HCV阳性，比较确切的解释是
A. 己感染丙型肝炎病毒
B. 对丙型肝炎病毒有免疫力
C. 体内有丙型肝炎病毒
D. 是慢性活动性肝炎
E. 急性丙肝患者

正确答案：A。己感染丙型肝炎病毒

解析：本题考查丙肝的诊断。丙肝的特异性诊断主要依靠血清学检测，主要的指标包括HCV RNA和抗HCV。当血清学检测结果呈现抗HCV阳性时，说明该患者已经感染丙型肝炎病毒（A对BCDE错）。